通过阻滞钙离子通道发挥药理作用的药物是
A. 维拉帕米
B. 普鲁卡因
C. 奎尼丁
D. 胺碘酮
E. 普罗帕酮

正确答案：A。维拉帕米

解析：本题考查钙通道阻滞剂。通过阻滞钙离子通道发挥药理作用的药物有：1，4-二氢吡啶类、芳烷基胺类、苯硫氮䓬和三苯哌嗪类，维拉帕米（A对）芳烷基胺类的主要代表药物。普鲁卡因（B错）阻滞钠离子通道。奎尼丁（C错）主要是抑制钠离子的跨膜运动，其次为抑制钙离子内流。胺碘酮（D错）主要是延长心脏纤维动作电位Ⅲ相时程以减少钾内流。普罗帕酮（E错）主要是抑制钠离子的内流。